女，38岁。上腹不适，纳差3年体重减轻，乏力半年，查体：贫血貌，上腹部轻压痛，Hb88g/L，MCV115fl，胃镜检查示胃体皱襞稀疏，黏膜血管透见。对诊断最有意义的辅助检查是
A. 血癌胚抗原
B. 血胃泌素
C. 血胃蛋白酶原
D. 血壁细胞抗体
E. 血抗线粒体抗体M2亚型

正确答案：D。血壁细胞抗体

解析：该患者诊断为慢性萎缩性胃炎。慢性萎缩性胃炎分为A型胃炎（自身免疫性胃炎）和B型胃炎，A型胃炎累及部位为胃体、胃底，B型胃炎累及部位为胃窦，该患者病变主要集中在胃体，所以可诊断为A型胃炎。A型胃炎血壁细胞抗体和内因子抗体阳性，因此查血壁细胞抗体对诊断最有意义（D对）。血癌胚抗原（A错）主要用于诊断结直肠癌。血胃泌素（B错）、血胃蛋白酶原（C错）测定对慢性胃炎的诊断价值不大。血抗线粒体抗体M₂亚型（E错）主要用于诊断原发性胆汁性肝硬化。